对污染源进行评价可采用
A. 流行病学和卫生毒理学方法
B. 流行病学和卫生统计方法
C. 卫生统计法和卫生毒理学方法
D. 排毒系数和等标污染负荷方法
E. “三致”方法

正确答案：D。排毒系数和等标污染负荷方法